肺胀患者，神志恍惚，烦躁不宁，咳逆喘促，咯痰不爽，舌暗苔淡黄而腻，脉滑数。治疗应首选
A. 涤痰汤合苏合香丸
B. 涤痰汤合至宝丹
C. 玉枢丹
D. 菖蒲郁金汤
E. 通窍活血汤

正确答案：B。涤痰汤合至宝丹

解析：本病例已明确诊断为肺胀；痰迷心窍，蒙蔽神机，故见神志恍惚，烦躁不宁；肺虚痰蕴，则咳逆喘促，咯痰不爽；舌质暗，为心血瘀阻之象；苔淡黄腻，脉滑数均为痰浊蕴热之象，故属于痰蒙神窍证，治以涤痰，开窍，息风，代表方为涤痰汤，另服至宝丹或安宫牛黄丸以清心开窍（B对）。苏合香丸，其功用为芳香开窍，行气止痛，适用于寒闭证，本病例已有蕴热之势，不适宜使用本品(A错)。玉枢丹，其功用为化痰开窍，辟秽解毒，消肿止痛，适用于暑令时疫（C错）。菖蒲郁金汤，其功用为清营透热祛痰，适用于伏邪风温病证（D错）。通窍活血汤，其功用为活血化瘀，开窍醒脑，可用于痴呆之瘀血内阻证（E错）。